有关腓深神经的描述，正确的是
A. 伴随胫后动脉
B. 支配小腿前群肌
C. 分布于大部足背皮肤
D. 支配腓骨长肌
E. 支配腓骨短肌

正确答案：B。支配小腿前群肌

解析：腓深神经伴随胫前血管（A错）于胫骨前肌和趾长伸肌之间，继而在胫骨前肌与姆长伸肌之间下行，最后经踝关节前方达足背。沿途发出分支分布于小腿前群肌（B对）、足背肌及第1、2趾相对缘的皮肤（C错）。腓浅神经支配腓骨长肌（D错）和腓骨短肌（E错）。